婴儿死亡率的定义是
A. （某年出生婴儿死亡率/同年平均人口数）×1000‰
B. （某年婴儿死亡数/同年平均人口数）×1000‰
C. （某年婴儿死亡数/同年出生总数）×1000‰
D. （某年婴儿死亡数/同年活产数）×1000‰
E. 以上都不是

正确答案：D。（某年婴儿死亡数/同年活产数）×1000‰

解析：本题考查婴儿死亡率的概念。婴儿死亡率是反映一周岁以内婴儿死亡水平的指标，是指婴儿出生后不满周岁死亡人数与出生人数的比率。计算公式为：（某年婴儿死亡数/同年活产数）×1000‰（D对ABCE错）。